上腹部出现明显蠕动波，常见于下列哪项
A. 急性胃炎
B. 慢性胃炎
C. 胃癌
D. 溃疡病
E. 幽门梗阻

正确答案：E。幽门梗阻

解析：正常人腹部一般看不到胃和肠的轮廓及蠕动波，当胃肠道发生梗阻时，如幽门梗阻（E对），梗阻近端的胃或肠段饱满而隆起，可显出各自的轮廓，称为胃型或肠型，伴有该部位的蠕动增强，可以看到蠕动波。急性胃炎（A错）、慢性胃炎（B错）表现为上腹痛、腹胀、恶心、呕吐、食欲不振等，无胃肠蠕动波；胃癌（C错）早期无明显体征，进展期可扪及肿块，有压痛，一般无蠕动波；溃疡病（D错）主要以上腹痛和不适为主要症状，无胃肠蠕动波。